人食用被农药污染的水生生物后，对人体可产生的影响是
A. 通过食物链的逐级稀释，对人体产生微小的不良效应
B. 通过食物链的逐级稀释，对人体不产生不良效应
C. 通过食物链的逐级浓缩，对人体产生严重的不良效应
D. 农药不会通过食物链影响到人的健康
E. 以上说法都不对

正确答案：C。通过食物链的逐级浓缩，对人体产生严重的不良效应